基因工程的伦理原则中不正确的是
A. 集中用于疾病的治疗，而不是用于“优生”
B. 知情同意或知情选择
C. 保护基因隐私和反对基因歧视
D. 利用基因进行胚胎克隆
E. 努力促进人人平等民族和睦和国际和平

正确答案：D。利用基因进行胚胎克隆

解析：利用基因进行胚胎克隆的做法是不能允许的（D错，为本题正确答案）。基因治疗从定义可以看出，基因治疗的目的是治疗人类疾病，而不是增强人类的某些特性（A对）。基因治疗中应遵循的伦理原则：必须尊重病人的知情权、自主选择权（B对）。应用基因诊断，要严格遵守保密原则，检测结果应注意保密，保护受检测者的个人隐私。防止基因歧视，未经本人同意不得披露给单位（雇主）、保险公司、学校（C对）。基因工程的伦理原则包括促进人人平等民族和睦和国际和平（E对）。